关于颌面骨结核的X线片的描述正确的是
A. 骨质疏松脱钙，有小死骨块，与周围骨质无明显分开
B. 边缘清晰而不整齐的局限性骨破坏，但死骨及骨膜增生均少见
C. 骨质增生，小死骨块，与周围骨质分界线模糊
D. 大块死骨形成，与周围骨质分界清楚
E. 骨膜反应活跃，病变区与周围骨质分界模糊

正确答案：B。边缘清晰而不整齐的局限性骨破坏，但死骨及骨膜增生均少见

解析：颌面骨结核的X线片表现为边缘清晰而不整齐的局限性骨破坏。但死骨及骨膜增生均少见。掌握“颌面部骨结核、放线菌病”知识点。